流感病毒中致病力与变异性相比较，最高的是
A. 甲型流感病毒
B. 乙型流感病毒
C. 丙型流感病毒
D. 副流感病毒
E. 呼吸道合胞病

正确答案：A。甲型流感病毒

解析：甲型流感病毒致病力强，且易变异，是甲型流感的病原体，易引起较大范围人群的甲型流感流行甚至世界大流行。而乙型流感变异性弱，只感染人，丙型流感病毒的抗原性基本稳定，且乙丙二型病毒一般不形成新亚型，且致病力弱。掌握“正、副黏病毒”知识点。